男，2月。体重6kg，腹泻导致中度脱水。下列液体疗法叙述错误的是
A. 补充生理需要量600ml
B. 补充累计损失量300～600ml
C. 注意补充继续丢失量
D. 如临床上判断脱水性质有困难，可先按等渗性脱水处理
E. 原则上先慢后快

正确答案：E。原则上先慢后快

解析：中度脱水时，应补充累计损失量50～100ml/kg，即300～600ml（B对）；补充生理需要量100ml/kg，即600ml（A对）。补液原则应遵循先盐后糖、先浓后淡、先快后慢（E错，为本题正确答案）、见尿补钾、抽搐补钙。在开始补充累积损失量后，腹泻、呕吐、胃肠引流等损失大多继续存在，以致体液继续丢失，如不予以补充，将又成为新的累积损失（C对）。如临床上判断脱水性质有困难，可先按等渗性脱水处理（D对）。